医生义务和权利中不包括
A. 保证治疗效果
B. 保证患者平等医疗权
C. 保证患者医疗权的实现
D. 保证患者身心健康
E. 履行自己的义务

正确答案：A。保证治疗效果

解析：医生义务和权力包括保证患者平等医疗权（B对）、保证患者医疗权的实现（C对）、保证患者身心健康（D对）、履行自己的义务（E对）等，医生具有发展医学科学事业的义务，医师应刻苦钻研新理论、新知识、新技术，具有献身和求实的精神，为促进医学科学的进步而努力，但治疗效果不能保证，应依据具体情况而定（A错，为本题正确答案）。